患者男性，56岁。凌晨关节疼痛惊醒，进行性加重，剧痛如刀割样或咬噬样，伴有发热、头痛、恶心、心悸、寒战，血液中血尿酸420μmol/L，最可能是
A. 类风湿性关节炎
B. 化脓性关节炎
C. 创伤性关节炎
D. 痛风
E. 继发性高尿酸血症

正确答案：D。痛风

解析：本题为痛风患者，由于尿酸盐累积过饱和而以晶体析出，进而诱发机体炎症的表现，本题患者凌晨关节疼痛发热头痛等都是机体炎症的表现，血尿酸又高于正常值，故最有可能是痛风，急性发作期可选用非甾体抗炎药或秋水仙碱等药物（D对）。类风湿关节炎与痛风均可见关节肿痛，但前者以中年女性多发，多为上肢小关节对称性肿痛，晨僵明显，类风湿因子或抗环瓜氨酸抗体阳性，血尿酸正常（A错）。化脓性关节炎局部有红肿疼痛及明显压痛等急性炎症表现。关节液增加，有波动，这在表浅关节如膝关节更为明显，有髌骨漂浮征，一般不会出现高血尿酸（B错）。创伤性关节炎临床上表现为受累关节疼痛、关节障碍，严重者可引起关节畸形，甚至致残以大关节多见，且有创伤史（C错）。继发性高尿酸症，它的高尿酸血症程度较重，痛风性关节炎症状往往较轻或不典型，而且容易被原发病的表现掩盖而被忽略，继发性高尿酸血症有明确的相关用药史（E错）。